水溶性维生素中化学性质较稳定的是
A. 维生素B₁
B. 维生素B₂
C. 维生素B₆
D. 维生素C
E. 维生素PP

正确答案：E。维生素PP